7-羟基香豆素的1H-NMR信号特征有
A. H-5呈双峰
B. H-6在较高场
C. H-6呈双峰
D. H-3呈双峰
E. H-8呈宽四重峰

正确答案：A、B、D。H-5呈双峰；H-6在较高场；H-3呈双峰